儿茶既可内服又可外用，主治广泛，但其不能主治的病证是
A. 疮疡不敛
B. 吐血、衄血
C. 寒痰哮喘
D. 外伤出血
E. 湿疹湿疮

正确答案：C。寒痰哮喘

解析：本题考查的是儿茶的主治病证。儿茶既可内服又可外用，主治广泛，但其不能主治的病证是寒痰哮喘（C错，为本题正确答案）。儿茶：【主治病证】（1）湿疮，湿疹（E对），疮疡不敛（A对）。（2）吐血，衄血（B对），外伤出血（D对）。（3）跌仆伤痛。（4）肺热咳嗽。寒痰哮喘为砒石的主治病证。砒石：【主治病证】（1）疮疡腐肉不脱，疥癣，瘰疬，牙疳。（2）寒痰哮喘。（3）疟疾。